对各种类型的结核病患者均为首选药物是
A. 氟康唑
B. 利巴韦林
C. 异烟肼
D. 甲硝唑
E. 多西环素

正确答案：C。异烟肼

解析：异烟肼对各种类型的结核病患者均为首选药物。掌握“氟康唑、利巴韦林及阿昔洛韦”知识点。